郁金除能活血止痛、行气解郁外，还能
A. 凉血清心
B. 清热解毒
C. 消积止痛
D. 接骨疗伤
E. 消肿排脓

正确答案：A。凉血清心

解析：本题考查的是郁金的功效。郁金除能活血止痛、行气解郁外，还能凉血清心（A对）。郁金：【功效】活血止痛，行气解郁，凉血清心，利胆退黄。虎杖：【功效】利湿退黄，清热解毒（B错），活血祛瘀，化痰止咳，泻下通便。莪术：【功效】破血行气，消积止痛（C错）。自然铜：【功效】散瘀止痛，接骨疗伤（D错）。穿山甲：【功效】活血消癥，通经下乳，消肿排脓（E错）。